女，30岁，半年行动退化，个性多疑，自觉有敌对公司监视，家里有监控器，窃听器，把家里墙板沙发拆掉没有发现，仍觉得有人监视，觉得家人被收买，在菜里下毒，自己买方便面吃，经常自言自语，突然大笑，考虑诊断
A. 精神分裂症
B. 妄想障碍
C. 强迫障碍
D. 分离障碍
E. 躁狂发作

正确答案：A。精神分裂症

解析：患者女，30岁，出现行动退化，个性多疑（精神分裂症的表现）等，结合患者的表现，提示为精神分裂症（A对）。（P99）妄想性障碍又称偏执性障碍，是指一组病因未明，以发展成一种或一整套相互关联的系统妄想（妄想症状持续三个月及以上）为主要表现的精神疾病。妄想发作时没有抑郁、躁狂及混合发作的心境障碍，也没有其他精神分裂症的特征性症状（如持续性的听幻觉、思维障碍及阴性症状）（B错）。（P137）强迫障碍 强迫障碍的恐惧源于自己内心的某些思想或观念，怕的是失去自我控制，并非对外界事物恐惧（C错）。（P152）分离障碍则是一类复杂的心理生理紊乱过程患者非自主地、间断地丧失部分或全部心理生理功能的整合能力，在感知觉、记忆情感、行为、自我（身份）意识及环境意识等方面的失整合，即所谓的分离状态，如自我身份不连续、不能用病理生理性解释的记忆丧失、躯体功能障碍而相应生理无改变等（D错）。（P123）躁狂发作的典型临床表现是情感高涨、思维奔逸、活动增多“三高＂症状，可伴有夸大观念或妄想、冲动行为等。发作应至少持续一周，并有不同程度的社会功能损害，可给自己或他人造成危险或不良后果（E错）。